给家兔静脉小剂量的肾上腺素后，心率增快，心缩力增强，但平均动脉压变化不大，这是因为肾上腺素
A. 强烈兴奋降压反射
B. 通过β受体扩张全身血管
C. 通过β受体扩张骨骼肌血管
D. 无缩血管效应
E. 不影响血管收缩

正确答案：C。通过β受体扩张骨骼肌血管